治疗温病气分证和胃热呕逆的药物是
A. 石膏
B. 夏枯草
C. 知母
D. 芦根
E. 淡竹叶

正确答案：D。芦根

解析：芦根具有清热泻火，生津止渴，除烦，止呕，利尿的功效，其性味甘寒，入肺胃二经，既能清泻肺胃气分实热，又能生津止渴，除烦；入胃经可清胃热而止呕，用于治疗胃热呕哕（D对）。石膏功效为生用：清热泻火，除烦止渴；煅用：收湿，生肌，敛疮，止血。治疗外感热病，高热烦渴；肺热喘咳；胃火亢盛，头痛牙痛，内热消渴；溃疡不敛，湿疹瘙痒，水火烫伤，外伤出血（A错）。夏枯草功效为清肝泻火，明目，散结消肿。治疗目赤肿痛，目珠夜痛，头痛眩晕；瘿瘤，瘰疬；乳痈，乳癖，乳房胀痛（B错）。知母功效为清热泻火，滋阴润燥。治疗外感热病，高热烦渴；肺热咳嗽，阴虚燥咳；骨蒸潮热；内热消渴；阴虚肠燥便秘（C错）。淡竹叶功效为清热泻火，除烦止渴，利尿通淋。治疗热病烦渴；口舌生疮，小便短赤涩痛（E错）。